微小病变性肾小球肾炎的特征性的病理表现为
A. 弥漫性毛细血管壁增厚
B. 弥漫性系膜细胞增生及系膜基质增厚
C. 肾小球的部分小叶发生硬化
D. 弥漫性上皮细胞足突消失
E. 大量新月体产生

正确答案：D。弥漫性上皮细胞足突消失

解析：微小病变性肾小球肾炎的特征性的病理表现为弥漫性上皮细胞足突消失（D对）。弥漫性毛细血管壁增厚（A错）为膜性肾小球病（P268）的病变特点。弥漫性系膜细胞增生性及系膜基质增厚（B错）为系膜增生性肾小球肾炎（P272）的病变特点。肾小球的部分小叶发生硬化（C错）为局灶性节段性肾小球硬化（P270）的病变特点。大量新月体产生（E错）为急进性肾小球肾炎（P267）的病变特点。